确诊霍乱的首选检查是
A. 尿培养
B. 血培养
C. 胆汁培养
D. 粪培养
E. 骨髓培养

正确答案：D。粪培养

解析：霍乱感染会引起烈性肠道传染病霍乱，霍乱弧菌可疑单独或生物膜形式存在于感染者的粪便中，故确诊霍乱的首选检查为粪培养，有腹泻症状粪便培养霍乱弧菌阳性可诊断为霍乱（D对）。